毛状白斑多发生在
A. 颊黏膜
B. 舌尖
C. 舌侧缘
D. 唇红
E. 口底

正确答案：C。舌侧缘

解析：毛状白斑发生在一侧或双侧舌缘，有的可蔓延至舌背和舌腹。掌握“艾滋病的口腔表征”知识点。